最符合肝硬化腹水改变的是
A. 腹水比重1.010，细胞总数200×10⁶/L，白细胞分类：N 45%，L 55%，蛋白定量15g/L，ADA正常
B. 腹水比重1.022，细胞总数12x10⁹/L，白细胞分类：N 92%，L 8%，蛋自定量40g/L，ADA正常
C. 腹水比重1.014，细胞总数500x10⁶/L，白细胞分类：N 80%，L 20%，蛋白定量27g/L，ADA正常
D. 腹水比重1.018，细胞总数800x10⁶/L，白细胞分类：N 30%，L 70%，蛋白定量30g/L，ADA升高
E. 腹水比重1.020，细胞总数5000x10⁶/L，白细胞分类：N 60%，L 40%，蛋白定量35g/L，ADA正常

正确答案：A。腹水比重1.010，细胞总数200×10⁶/L，白细胞分类：N 45%，L 55%，蛋白定量15g/L，ADA正常